治疗肝肾亏损，髓枯筋痿之痿证，应首选
A. 六味地黄丸
B. 虎潜丸
C. 大补阴丸
D. 补肝汤
E. 右归丸

正确答案：B。虎潜丸

解析：虎潜丸滋阴降火，强壮筋骨，主治肝肾不足，髓枯筋痿之痿证（B对）。六味地黄丸，其功用为滋补肝肾，可用于下消之肾阴亏虚证(A错)。大补阴丸，其功用为滋阴降火，适用于阴虚火旺证（C错）。补肝汤，其功用为养血滋阴，柔肝舒筋，适用于虚劳之肝阴虚证（D错）。右归丸，其功用为温补肾阳，填精益髓，可用于噎嗝之气虚阳微证，偏于阳虚者（E错）。